男性，72岁。因持续胸痛6小时入院，查体双肺底有少量湿啰音，诊断为急性心肌梗死，该患者心功能分级为
A. NYHA分级Ⅰ级
B. NYHA分级Ⅳ级
C. NYHA分级Ⅱ级
D. Killip分级为Ⅱ级
E. Killip分级为Ⅲ级

正确答案：D。Killip分级为Ⅱ级

解析：患者老年男性，因持续胸痛6小时入院，诊断为急性心肌梗死，故该患者心功能分级应按照Killip分级法，查体：双肺底有少量湿啰音，提示肺部啰音＜50%肺野，因此该患者的心功能分级为Killip分级Ⅱ级（D对E错）。而NYHA分级（P168）是没有急性心肌梗死但患有心力衰竭患者的心功能分级标准，共分为四级，其中NYHA分级I级（A错）指心脏病患者日常活动量不受限制，一般活动不引起乏力、呼吸困难等心衰症状；NYHA分级IV级（B错）指心脏病患者不能从事任何体力活动，休息状态下也存在心衰症状，活动后加重；NYHA分级Ⅱ级（C错）指心脏病患者体力活动轻度受限，休息时无自觉症状，一般活动下可出现心衰症状。